属于前体药物开环抗病毒的是
A. 阿昔洛韦
B. 伐昔洛韦
C. 更昔洛韦
D. 泛昔洛韦
E. 阿德福韦酯

正确答案：B、D、E。伐昔洛韦；泛昔洛韦；阿德福韦酯

解析：本题考查开环核苷类抗病毒药。伐昔洛韦（B对）、泛昔洛韦（D对）、阿德福韦酯（E对）属于前体药物开环抗病毒药。阿昔洛韦（A错）、更昔洛韦（C错）可直接发挥抗病毒作用，非前药。